葡萄球菌在生长过程中能够产生的毒素有
A. 溶血素
B. 外毒素
C. 肠毒素
D. 杀白细胞素
E. 以上都有

正确答案：E。以上都有